病例对照研究主要检验表示暴露与疾病关联强度，即
A. 相对危险度
B. 比值比
C. 超额危险度
D. 归因危险度
E. 归因危险度百分比

正确答案：B。比值比

解析：本题考查病例对照研究的关联强度分析指标。描述暴露与疾病联系强度的指标是相对危险度，但病例对照研究中没有暴露组和非暴露组的观察人数，不能计算发病率，可用比值比（B对ACDE错）来近似估计RR。比值比又称比数比、优势比，为病例组与对照组两组暴露比值之比。